关于外毒素的叙述，哪项错误
A. 化学成分是蛋白质
B. 毒性作用强，对组织有选择性
C. 受甲醛处理形成类毒素
D. 毒性部分是类脂A
E. 多由革兰阳性菌产生，不耐热

正确答案：D。毒性部分是类脂A